患者，女，27岁，孕32周，4天前受凉后开始持续发热，体温最高达39.5℃，伴咽痛、声音嘶哑。查体：扁桃体Ⅲ度肿大，咽部表面有脓点。患者否认药物过敏史。该患者首选的抗感染治疗药物是
A. 阿米卡星注射液，600mg qd ivgtt，3天
B. 青霉素V钾片，250mg qid po，10天
C. 左氧氟沙星注射液，500mg qd iv gtt，5天
D. 阿奇霉素片，500mg qd po，3天
E. 注射用头孢哌酮舒巴坦钠，4.5g q12h iv gtt，10天

正确答案：B。青霉素V钾片，250mg qid po，10天

解析：本题考查急性扁桃体炎的抗菌治疗。患者出现了扁桃体肿大，且有脓点，可诊断为急性扁桃体炎。抗菌治疗可选用口服青霉素V钾或阿莫西林，疗程10天（剂量和频次为250mg qid po或500mg bid po）（B对）；或苄星青霉素单次肌内注射。使用阿奇霉素的疗程为3天（D错），克林霉素和头孢菌素类的疗程为5～7天（E错）。不应使用复方磺胺甲噁唑和四环素类，因为抗菌有效性不足并可能增加不良反应。呼吸喹诺酮类药物（C错）对A组链球菌有抗菌活性，但由于抗菌谱广，且过度使用可能延迟结核病的诊断，增加结核分枝杆菌对喹诺酮类药物的耐药性，不建议用于常规治疗。